内毒素的主要成分是
A. 肽聚糖
B. 蛋白质
C. 脂蛋白
D. 核酸
E. 脂多糖

正确答案：E。脂多糖

解析：本题考查内毒素的主要成分。内毒素的主要成分是脂多糖（E对）。蛋白质（B错）可见于多数革兰阳性菌和少数革兰阴性菌在生长繁殖过程中释放到菌体外的外毒素。肽聚糖（A错）可见物细菌的细胞壁。脂蛋白（C错）可见于革兰阴性细菌细胞壁的外膜。核酸（D错）可见于细菌的核质。